婴幼儿的咽鼓管较成人为
A. 粗而长
B. 弯而细
C. 长而弯
D. 短、粗、水平
E. 骨→锤骨→镫骨

正确答案：D。短、粗、水平

解析：婴幼儿的咽鼓管较成人短、粗、水平（D对）。